毒蕈中毒时，应特别注意
A. 一种毒蕈只含一种特定毒系，有靶器官，故抢救时需认真鉴别
B. 中毒者潜伏期均较短，故应紧急采取措施
C. 任何毒蕈均难溶于水
D. 发病率低，但病死率高，应集中抢救
E. 白毒伞等致肝肾损害型的毒蕈中毒后，临床可出现假愈期，仍需继续保护肝肾

正确答案：E。白毒伞等致肝肾损害型的毒蕈中毒后，临床可出现假愈期，仍需继续保护肝肾